响度级的单位为
A. 赫兹
B. 分贝
C. 巴
D. 㕫
E. 米/秒²

正确答案：D。㕫

解析：本题考查响度级的单位。响度级是根据人耳对声音的感觉特性，联系声压和频率测定出人耳对声音音响的主观感觉量，单位为㕫（D对ABCE错）。